毫针斜刺的角度是
A. 10°左右
B. 15°左右
C. 30°左右
D. 45°左右
E. 90°

正确答案：D。45°左右

解析：斜刺是针身与皮肤表面呈45°左右倾斜刺入（D对）。平刺是针身与皮肤表面呈15°左右或沿皮肤以更小的角度刺入（AB错）。针刺的角度没有30°（C错）。直刺是针身与皮肤表面呈90°垂直刺入（E错）。